某男，17岁。皮肤大片风团，色红，瘙痒剧烈，伴有脘腹疼痛，嗳气恶心，神疲纳呆，大便秘结，舌红苔薄黄，脉弦滑数。诊断为瘾疹。宜选用的中成药是
A. 荆肤止痒颗粒
B. 防风通圣丸
C. 皮敏消胶囊
D. 消风止痒颗粒
E. 润燥止痒胶囊

正确答案：B。防风通圣丸

解析：本题考查瘾疹之胃肠湿热证的中成药应用。患者为瘾疹之胃肠湿热证，宜选用的中成药是防风通圣丸（B对）。瘾疹之胃肠湿热证【症状】风团大片色红，瘙痒剧烈；发疹的同时伴脘腹疼痛，恶心呕吐，神疲纳呆，大便秘结或泄泻。舌质红，苔薄白或黄，脉弦滑数。【中成药应用】常用中成药：防风通圣丸、皮肤病血毒丸、乌蛇止痒丸。瘾疹之风热犯表证【症状】风团鲜红，灼热剧痒，遇热则剧，得冷则减；伴发热，恶寒，咽喉肿痛。舌质红，苔薄白或薄黄，脉浮数。【中成药应用】常用中成药：荆肤止痒颗粒（A错）、皮敏消胶囊（C错）、消风止痒颗粒（D错）。瘾疹之血虚风燥证【症状】反复发作，迁延日久，午后或夜间加剧；伴心烦易怒，口干，手足心热。舌红少津，脉沉细。【中成药应用】常用中成药：润燥止痒胶囊（E错）。